属于脑神经核的是
A. 红核
B. 薄束核
C. 黑质
D. 疑核
E. 楔束核

正确答案：D。疑核

解析：疑核接受双侧皮质核束的传入，其上部发出纤维进入舌咽神经（第IX对脑神经）；中部发出纤维进入迷走神经（第X对脑神经）；下部发出纤维进入副神经（第XI对脑神经），因疑核与脑神经相连，故疑核（D对）属于脑神经核。红核（A错）、黑质（C错）、薄束核（B错）、楔束核（E错）均不与脑神经相连，因而不属于脑神经核。